治疗痢疾之休息痢，应首选
A. 不换金正气散
B. 芍药汤
C. 驻车丸
D. 桃花汤
E. 连理汤

正确答案：E。连理汤

解析：不换金正气散为痢疾之寒湿痢的选方，功能燥湿运脾（A错）。芍药汤为痢疾之湿热痢的选方，功能调气行血，清热解毒（B错）。驻车丸常合黄连阿胶汤治疗痢疾之阴虚痢，功能坚阴养血，清热化湿（C错）。桃花汤常合真人养脏汤治疗痢疾之虚寒痢，功能温中涩肠（D错）。痢疾之休息痢为久病伤正，邪恋肠腑，传导不利所致，治宜温中清肠，调气化滞，方选连理汤（E对）。